药物信息的收集和获取来自
A. 各种药学专业期刊的资料
B. 医药继续教育讲座的资料
C. 医药学术会议交流的资料
D. 医护人员提供的临床资料
E. 制药企业推荐新药的资料

正确答案：A、B、C、D。各种药学专业期刊的资料；医药继续教育讲座的资料；医药学术会议交流的资料；医护人员提供的临床资料